麦冬的后含物
A. 草酸钙簇晶
B. 草酸钙砂晶
C. 草酸钙针晶束
D. 草酸钙方晶
E. 碳酸钙结晶

正确答案：C。草酸钙针晶束

解析：本题考查麦冬的显微鉴别。麦冬的后含物是草酸钙针晶束（Ｃ对）。麦冬粉末：白色或黄白色。草酸钙针晶散在或成束于黏液细胞中，针晶长25～50㎛；柱状针品长至88㎛，直径8～13㎛。何首乌粉末：黄棕色。草酸钙簇晶（Ａ错）较多，直径10～80（160）㎛，偶见簇晶与较大的方晶合生。枸杞根皮粉末：米黄色。草酸钙砂晶（Ｂ错）随处可见，结晶极细微，略呈箭头形，有的薄壁细胞充满砂晶。葛根粉末：淡棕色。纤维多成束，壁厚，木化，周围细胞大多含草酸钙方晶（Ｄ错），形成晶鞘纤维，含晶细胞的壁增厚木化。